男，28岁。右大腿清创缝合术后6天，发热，局部伤口红肿，范围较大，疼痛明显。伤口局部见稀薄脓液，淡红色，量多，无异味。最可能感染的致病菌是
A. 大肠埃希菌
B. 铜绿假单胞菌
C. 溶血性链球菌
D. 金黄色葡萄球菌
E. 无芽孢厌氧菌

正确答案：C。溶血性链球菌

解析：溶血性链球菌（C对）脓液的特点为稀薄，淡红色，量多，无异味。大肠埃希菌（A错）脓液的特点为稠厚，无臭味。铜绿假单胞菌（B错）的脓液特点为淡绿色，有特殊腥臭味。金黄色葡萄球菌（D错）脓液特点为稠厚，色黄，无臭味。无芽孢厌氧菌（E错）生长需无氧环境，见于较深的创口或会阴部手术，脓恶臭。